硫酸镁缓解子痫的给药方式是
A. 口服
B. 静脉注射
C. 外用热敷
D. 皮下注射
E. 直肠给药

正确答案：B。静脉注射

解析：本题考查给药途径。硫酸镁缓解子痫的给药方式是静脉注射（B对）。硫酸镁给药途径不同，产生的药效也不同。肌内注射或静脉注射给药时，可产生中枢镇静、抑制作用，临床主要用于缓解子痫、破伤风等惊厥；而口服（A错）则产生导泻作用，常用作泻下药。